与其它抗结核病药联合使用的药物是
A. 庆大霉素
B. 链霉素
C. 奈替米星
D. 妥布霉素
E. 小诺米星

正确答案：B。链霉素

解析：本题考查链霉素。链霉素（B对）与其它抗结核药联合用于结核分枝杆菌所致各种结核病的初治病例。庆大霉素（A错）广泛用于治疗许多严重的革兰阴性杆菌感染及敏感细菌所致中枢神经系统感染。奈替米星（C错）用于治疗敏感的肠杆菌科和其它需氧的革兰阴性杆菌引起的严重感染，以及除肠球菌外的某些庆大霉素耐药菌株所致感染。妥布霉素（D错）与一种抗绿脓杆菌青霉素、氨曲南或头孢他啶合用，治疗绿脓杆菌引起的各种感染。小诺米星（E错）为氨基糖苷类抗菌药物，抗菌作用与庆大霉素相似，且对细菌产生的乙酰转移酶稳定。